疾病的三间分布是指
A. 年龄、性别、季节分布
B. 年龄、季节、职业分布
C. 年龄、季节、地区分布
D. 地区、季节、职业分布
E. 时间、地区、人群分布

正确答案：E。时间、地区、人群分布

解析：本题考查疾病的三间分布。疾病的三间分布是指时间、地区、人群分布（E对ABCD错）。